为预防甲氨蝶呤所致的肾毒性，在化疗期间，除大量水化和利尿外，还应同时给予的尿路保护剂是
A. 呋塞米
B. 氯噻酮
C. 美司钠
D. 坦洛新
E. 亚叶酸钙

正确答案：C。美司钠

解析：本题考查美司钠。抗代谢药甲氨蝶呤属弱酸性药，主要由肾小球滤过和肾小管分泌排泄，长期应用甲氨蝶呤会引起肾毒性。为预防肾毒性，化疗期间除了补充大量水和给予利尿剂外，还应同时给予尿路保护剂美司钠（C对）。氯噻酮（B错）主要用于水肿性疾病，排泄体内过多的钠和水，减少细胞外液容量，消除水肿。坦洛新（D错）主要用于治疗前列腺增生所致的异常排尿症状，适用于轻、中度患者及未导致严重排尿障碍者。亚叶酸钙（E错）用于大剂量应用甲氨蝶呤后导致的黏膜损害和骨髓抑制，一般不用于甲氨蝶呤所致的肾毒性。